脊髓半边横断的表现有
A. 同侧触觉缺失
B. 对侧本体感觉缺失
C. 同侧温度觉缺失
D. 同侧痛觉缺失
E. 没有上述情况

正确答案：E。没有上述情况

解析：脊髓半边横断的表现有伤平面以下，同侧肢体痉挛性瘫痪，位置觉、震动觉和精细触觉丧失（AB错），损伤节段下 1 -2 个节段平面以下的对侧痛、温觉丧失（CD错），综上脊髓半边横断的表现没有上述情况（E对）。